女性，60岁。反复咳嗽、咳痰25年，心悸、气促、下肢间歇水肿3年，病情加重伴畏寒发热1周入院。体检：T38℃，呼吸急促，口唇发绀，双肺叩诊过清音，中下肺有湿啰音，心率110次/分，心律齐，无杂音，双下肢重度水肿。假设该病例呼吸困难进一步加重，右肺呼吸音明显较前减弱，应立即进行的检查是
A. 胸部X线检查
B. 心电图检查
C. 动脉血气分析
D. 痰培养及药敏试验
E. 血胆固醇和甘油三酯测定

正确答案：A。胸部X线检查

解析：患者为老年女性，反复咳嗽、咳痰25年（为慢阻肺的标志性症状），查体双肺叩诊过清音，诊断慢性阻塞性肺疾病（COPD）。病情加重伴畏寒发热，说明为慢性阻塞性肺疾病急性加重期。患者有下肢间歇水肿病史3年，现双下肢重度水肿，表明已出现右心衰竭，考虑为慢性肺源性心脏病。患者有突然加重的呼吸困难，有明显发绀的症状，并进一步加重，右肺呼吸音减弱，怀疑并发自发性气胸，为明确诊断，首选胸部X线检查（A对）。动脉血气分析（C错）多在病人昏迷、病情危重时了解病情严重程度。心电图检查（B错）主要是了解各种心律失常、心肌缺血/梗死、房室肥大或电解质紊乱等。痰培养及药敏试验（D错）主要用于诊断肺炎及确诊肺炎的致病菌。血胆固醇和甘油三酯测定（E错）主要用来测定人体血脂，对本例的确诊价值不大。